操作热压灭菌柜时应注意的事项中不包括
A. 必须使用饱和蒸汽
B. 必须将灭菌柜内的空气排除
C. 灭菌时间应从开始灭菌时算起
D. 灭菌完毕后应停止加热
E. 必须使压力逐渐降到零才能放出柜内蒸汽

正确答案：C。灭菌时间应从开始灭菌时算起